膀胱的分部没有
A. 膀胱尖
B. 膀胱头
C. 膀胱颈
D. 膀胱体
E. 膀胱底

正确答案：B。膀胱头

解析：膀胱分分尖（A错）、体（D错）、底（E错）和颈（C错）四部，没有膀胱头（B对）部。